被称为颈部淋巴上皮囊肿的是
A. 鳃裂囊肿
B. 根尖周囊肿
C. 鼻牙槽囊肿
D. 牙龈囊肿
E. 萌出囊肿

正确答案：A。鳃裂囊肿

解析：鳃裂囊肿又称为颈部淋巴上皮囊肿。掌握“鳃裂囊肿”知识点。